冠心病植入药物洗脱支架者，需要接受阿司匹林及氯吡格雷抗血小板治疗的时间至少为
A. 12个月
B. 1个月
C. 9个月
D. 6个月
E. 3个月

正确答案：A。12个月

解析：冠心病患者植入药物洗脱支架后，为控制缺血症状、降低心肌梗死和死亡的发生，需要接受阿司匹林及氯吡格雷抗血小板治疗的时间至少为12个月（A对）。